属于人工绝经的是
A. 医源性因素丧失卵巢功能后月经终止
B. 生理性卵巢功能丧失而导致月经终止
C. 子宫切除导致月经终止
D. 子宫内膜结核导致月经终止
E. 营养不良导致月经终止

正确答案：A。医源性因素丧失卵巢功能后月经终止

解析：本题考查人工绝经的相关内容。人工绝经指手术切除双卵巢或医疗性终止双卵巢功能，即医源性因素丧失卵巢功能后月经终止（A对BCDE错）。